响度的单位“宋”是
A. 以频率为300Hz，声压级为40dB的声音，由听者所感觉到的响度为基准
B. 以频率为500Hz，声压级为40dB的声音，由听者所感觉到的响度为基准
C. 以频率为1000Hz，声压级为40dB的声音，由听者所感觉到的响度为基准
D. 以频率为1000Hz，声压级为60dB的声音，由听者所感觉到的响度为基准
E. 以频率为1000Hz，声压级为70dB的声音，由听者所感觉到的响度为基准

正确答案：C。以频率为1000Hz，声压级为40dB的声音，由听者所感觉到的响度为基准

解析：本题考查响度的单位。声强级是一个相对量，有时需要用绝对值来表示,故引出单位“宋”的概念。1宋的定义为声强级为40dB，频率为1000Hz，且来自听者正前方的平面波形的强度（C对ABDE错）。